患者，女，24岁。患腿痈1周，溃腐3天，脓腐稠厚且多，不易脱落。外用掺药应首选
A. 青黛散
B. 八二丹
C. 红灵丹
D. 八宝丹
E. 三石散

正确答案：B。八二丹

解析：患者腿痈溃腐难脱，应选用提脓祛腐药使痈毒早日排出，八二丹为提脓祛腐药的其中一类（B对）。青黛散是清热收涩药的一类，以其清热止痒的作用较强，故用于皮肤病大片潮红丘疹而无渗液者。（A错）。红灵丹是消散药的一类，适用于肿疡初起而肿势局限尚未成脓者（C错）。八宝丹是生肌收口药的一类，适用于溃疡腐肉己脱、脓水将尽时（D错）。三石散是清热收涩药的一类，其收涩生肌作用较好，故用于皮肤糜烂、稍有渗液而无红热之时（E错）。